在高效液相色谱法的系统适用性试验中，除另有规定外,用峰高法定量时，对拖尾因子的要求是
A. 0.3～0.7
B. ＞1.5
C. ≤2.0%
D. ≤0.1%
E. 0.95～1.05

正确答案：E。0.95～1.05